不宜单独用作甲亢内科治疗的药物是
A. 碘化物
B. 甲基硫氧嘧啶
C. 丙基硫氧嘧啶
D. 甲硫咪唑
E. 卡比马唑

正确答案：A。碘化物

解析：大剂量碘的抗甲状腺作用快而强，但是腺泡细胞内碘离子浓度增高到一定程度，细胞摄碘即自动降低，使胞内碘离子浓度下降，从而失去抑制激素合成的效应，此为碘化物不能单独用于甲亢内科治疗的原因。掌握“硫脲类药物”知识点。